下列属于评价量表的主要指标是
A. 灵敏度和特异度
B. 可行性和偏倚大小
C. 信度和效度
D. 重复性和真实性
E. 可行性、信度、效度、敏感度等

正确答案：E。可行性、信度、效度、敏感度等

解析：本题考查评价量表的主要指标。评价量表的主要指标包括可行性、信度、效度、敏感度等（E对ABCD错）。